妊娠8、9个月时，或腹中痛，痛定仍然如常者，称为
A. 试胎
B. 养胎
C. 垢胎
D. 盛胎
E. 滑胎

正确答案：A。试胎

解析：《医宗金鉴·妇科心法要诀》说：妊娠八九个月时，或腹中痛，痛定仍然如常者，此名试胎（A对）。指妊娠期注意饮食起居，护养胎儿的方法（B错）。妊娠早期仍按月有少量阴道流血，但无损于胎儿者，称为激经，亦称盛胎或垢胎（CD错）；滑胎（E错）为堕胎或小产连续发生3次或3次以上者。